一位医生在为其患者进行角膜移植手术的前一夜，发现备用的眼球已经失效，于是到太平间看是否有尸体能供角膜移植之用，恰巧有一尸体。考虑到征求死者家属意见很可能会遭到拒绝，而且时间也紧迫，于是便取出了死者的一侧眼球，然后用义眼代替，尸体火化前，死者家属发现此事，便把医生告上法庭。经调查，医生完全是为了患者的利益，并没有任何与治疗无关的动机，对此案例的分析，下列说法最恰当的是
A. 此案例说明我国器官来源的缺乏
B. 此案例说明我国在器官捐赠上观念陈旧
C. 此案例说明医院对尸体的管理有问题
D. 此案例说明首先征得家属的知情同意是一个最基本的伦理原则
E. 此案例说明医生为了患者的利益而摘取眼球在伦理学上是可以得到辩护的

正确答案：D。此案例说明首先征得家属的知情同意是一个最基本的伦理原则